口内检查中对牙的视诊应包括
A. 颜色和光泽
B. 形状和大小
C. 数目
D. 排列和接触关系
E. 以上均是

正确答案：E。以上均是

解析：本题考查口内检查中对牙的视诊。口内检查中对牙的视诊应包括：1.颜色和光泽（A对）：牙齿在颜色和透明度的某些改变常能为诊断提供线索。2.形状和大小（B对）：牙齿的先天缺陷容易导致牙齿硬组织破坏，进而导致牙髓炎等，另外还有过大牙、过小牙和锥形牙等牙齿形态异常。3.数目（C对）：检查牙列是否完整有无缺失牙，以确定是否需要修复治疗。4.排列和接触关系（D对）：有无错位、倾斜、扭转、深覆盖、深覆（牙合）、开（牙合）、反（牙合）等牙列紊乱情况。（ABCD均对，故E为本题的正确答案）。